女性，30岁，反复发作性呼吸困难，胸闷2年。3天前受凉后咳嗽，咳少量脓痰，接着出现呼吸困难胸闷，并逐渐加重。体检：无发绀，双肺广泛哮鸣音，肺底部少许湿啰音。表明气道阻塞具有可逆性的检查结果是
A. 一秒钟用力呼气容积（FEV₁）＞60%预计值
B. 最大呼气流量（PEF）＞60%预计值
C. 吸入沙丁胺醇后FEV₁增加率＞15%
D. 吸入倍氯米松后FEV₁增加率＞15%
E. 支气管激发试验阳性

正确答案：C。吸入沙丁胺醇后FEV₁增加率＞15%

解析：患者为青年女性，有反复发作性的呼吸困难和胸闷，受冷空气的刺激后，症状加重，双肺闻及广泛的哮鸣音，考虑为支气管哮喘，且为胸闷变异性哮喘（以胸闷为唯一症状的不典型哮喘称胸闷变异性哮喘）。支气管舒张实验（BDT）用以测定气道的可逆性改变。常用的吸入支气管舒张剂有沙丁胺醇（C对D错）、特布他林，吸入支气管舒张剂20分钟后重复测定肺功能，FEV₁较用药前增加≥12%，且绝对值增加≥200ml，判断结果为阳性，提示存在可逆性的气道阻塞。一秒钟用力呼气容积（FEV₁）＞60％预计值（A错）是判断慢性阻塞性肺疾病的严重程度的指标。最大呼气流量（PEF）＞60％预计值（B错）主要反映呼吸肌的力量及气道有无阻塞。支气管激发试验阳性（E错）是用来测定气道的反应性，并不表明气道阻塞具有可逆性。